男，50岁，车祸致枕部着地，昏迷1小时，查体：P50次/分，R12次/分，BP170/100mmHg，右枕部头皮挫伤灶，GCS5分，瞳孔左：右=4mm：2mm，左侧对光反射消失，右侧肢体偏瘫。对诊断最有价值的检查是
A. 腰椎穿刺
B. 头颅超声
C. 头颅CT
D. 脑血管造影
E. 头颅X线平片

正确答案：C。头颅CT

解析：车祸致枕部着地，瞳孔左：右=4mm：2mm（瞳孔正常直径为3-4mm，双侧瞳孔大小不等），左侧对光反射消失（双侧瞳孔不等且伴有对光反射减弱或消失以及神志不清，往往是中脑功能损害的表现）（九版诊断学P107），右侧肢体偏瘫（脑损伤的表现），昏迷，血压上升、脉搏变慢、呼吸深慢，GCS5分（重型脑外伤），因此诊断为重型脑损伤（P185）。头颅CT（C对）能清楚地显示脑挫裂伤的部位、范围和程度，是对诊断最有价值的检查。对发现较轻的脑挫伤灶，MRI优于CT。腰椎穿刺可检查脑脊液是否含有血液，同时可测定颅内压，并可引流血性脑脊液，以减轻症状。但对颅内压明显增高的病人，腰穿应谨慎或禁忌。